下列哪项可以引起再灌注时细胞内钙超载
A. H+-Ca2+的交换加强
B. K+-Ca2+交换加强
C. Na+-Ca2+交换加强
D. Mg+-Ca2+交换加强
E. Zn+-Ca2+交换加强

正确答案：C。Na+-Ca2+交换加强

解析：Na+-Ca2+交换加强（C对）是缺血－再灌注时Ca2+超载的主要途径，细胞内Na+明显升高或膜内正电位等，Na+/Ca2+交换蛋白则以反向转运的方式将细胞内Na+排出，细胞外Ca2+进入细胞。